患者确需临床输血的，应由经治医师逐项填写的医疗文书是
A. 输血治疗同意书
B. 临床输血申请单
C. 交叉配血报告单
D. 输血反应回报单
E. 同型输血认可书

正确答案：B。临床输血申请单

解析：需临床输血的，应由经治医师逐项填写的医疗文书是临床输血申请单（B对）。输血治疗同意书（A错）需由医生告知患者，然后由患者或其家属签字。